患者，女，30岁。见面色萎黄，唇甲色淡，又出现燥咳痰少，咽喉干燥，痰中带血，心烦不得眠。宜选药物是
A. 当归
B. 熟地黄
C. 何首乌
D. 白芍
E. 阿胶

正确答案：E。阿胶

解析：面色萎黄，唇甲色淡，为血虚不润；心血不足日久，出现心阴不足，而表现为心烦不得眠；同时出现了干咳痰少的燥痰，用能够补血滋阴，润燥止血的阿胶治疗（E对）。当归（A错）的功效是补血和血，调经止痛，润肠通便。熟地（B错）的功效是补血滋阴，益精填髓。何首乌（C错）的功效是解毒，消痈，截疟，润肠通便。白芍（D错）的功效是养血调经，敛阴止汗，柔肝止痛，平抑肝阳。